下列各项，不能导致妇女月经先期的是
A. 肾气不足
B. 阳盛血热
C. 营血亏损
D. 阴虚火旺
E. 脾气亏虚

正确答案：C。营血亏损

解析：肾气不足，冲任不固，不能制约经血，可致月经先期（A对）。阳盛血热，热扰冲任、胞宫，迫血下行，可致月经先期（B对）。营血亏损，冲任不充，血海不能按时满溢，可致月经后期（C错，为本题正确答案）。阴虚火旺则虚热内生，热伏冲任，血海不宁，可致月经先期（D对）。脾气亏虚则中气虚弱，冲任不固，经血失统，可致月经先期（E对）。